对口腔科医生最危险的是
A. 疱疹
B. 肠炎
C. 痢疾
D. 乙肝
E. 脑炎

正确答案：D。乙肝

解析：乙肝病毒是一种耐热的病毒，在95℃时要5分钟才能将其杀灭，这种病毒在工作台表面可存活几周，较污染器械上的存活期长。在血液和血制品中可以发现HBV，唾液、血液，痰，母乳、眼泪、伤口分泌的液体、尿、精液及月经中都可以发现HBV，仅需极少量的病毒就可以导致感染。在没有应用乙肝疫苗的国家和地区，口腔卫生及有关人员仍属高危人群。掌握“口腔医疗保健中的感染”知识点。